2002年11月至2003年6月初，我国发生了严重急性呼吸综合征（SARS）流行，SARS病死率是根据以下哪些数据计算出的
A. 全部患病者中死亡病例数占总人口的比例
B. 患该病的死亡者占同期暴露人口数
C. 全部确诊患者和疑似患者中因该病死亡者的比例
D. 全部确诊患者中因该病死亡者的比例
E. 该病的全部死亡病例占该期的平均人口数的比例

正确答案：D。全部确诊患者中因该病死亡者的比例